有关经皮吸收制剂的正确表述是
A. 可以避免肝脏的首过效应
B. 可以维持恒定的血药浓度
C. 可以减少给药次数
D. 不存在皮肤的代谢与储库作用
E. 常称为透皮治疗系统（TTS）

正确答案：A、B、C、E。可以避免肝脏的首过效应；可以维持恒定的血药浓度；可以减少给药次数；常称为透皮治疗系统（TTS）

解析：本题考查经皮给药制剂。经皮给药制剂又称为透皮给药系统或透皮治疗系统（简称TDDS或TTS）（E对），系指药物由皮肤吸收进入全身血液循环。经皮给药制剂优点：可以避免肝脏的首关效应（A对）；可以维持恒定的血药浓度（B对）；减少用药次数（C对）。